下列哪项不属于孕产期保健服务指标
A. 孕早期检查率
B. 恶性肿瘤发病率
C. 孕产妇艾滋病病毒治疗比例
D. 住院分娩率
E. 住院分娩的新生儿乙肝疫苗首针及时接种率

正确答案：B。恶性肿瘤发病率

解析：本题考查孕产期保健服务指标。恶性肿瘤发病率（B错，为本题正确答案）属于妇女常见病筛查指标。孕产期保健服务指标包括：孕期建卡率、孕早期检查率（A对）、孕产妇艾滋病病毒治疗比例（C对）、孕产妇梅毒检测率、产前筛查率、住院分娩率（D对）、住院分娩的新生儿乙肝疫苗首针及时接种率（E对）等等。